女，18岁，右下颌膨隆畸形2年，无疼痛。如果检查见右下颌骨膨隆，骨性硬度。X线表现呈右下颌骨密度均匀增高，呈磨砂玻璃状；右下颌骨外形膨大，骨密质变薄。诊断应为
A. 牙源性边缘性颌骨骨髓炎
B. 骨纤维异常增殖症
C. 成骨肉瘤
D. 成釉细胞瘤
E. 颌骨中央性癌

正确答案：B。骨纤维异常增殖症

解析：本题考查骨纤维异常增殖症。根据题目中的信息可知该18岁女性患者的X线表现呈右下颌骨密度均匀增高，呈磨砂玻璃状；右下颌骨外形膨大，骨密质变薄，与骨纤维异常增殖症的表现一致，因此可诊断为骨纤维异常增殖症（B对）。牙源性边缘性颌骨骨髓炎（A错）的好发部位为下颌骨，其中又以下颌支及下颌角部居多，边缘性颌骨骨髓炎慢性期X线可见骨皮质疏松脱钙或骨质增生硬化，或有小死骨块，与周围骨质无明显分界。骨肉瘤也叫成骨肉瘤（C错），突出症状是肿瘤部位的疼痛，由肿瘤组织浸蚀和溶解骨皮质所致；典型的骨肉瘤的X线表现为骨组织同时具有新骨生成和骨破坏的特点。典型成釉细胞瘤（D错）的X线表现：早期呈蜂房状，以后形成多房性囊肿样阴影，单房比较少；成釉细胞瘤因为多房性及有一定程度的局部浸润性，故周围囊壁边缘常不整齐、呈半月形切迹；在囊内的牙根尖可有不同程度的吸收现象。下唇麻木常是中央性颌骨癌（E错）的首要症状，X线片早期表现为病损局限于根尖区骨松质之内，呈不规则虫蚀状破坏；以后才破坏并浸润骨密质。